关于吸入气雾剂和吸入喷雾剂的吸收与影响因素的说法，错误的是
A. 药物以雾状吸入可直接作用于支气管平滑肌
B. 吸入给药的吸收速度与药物的脂溶性大小成正比
C. 吸入的雾滴（粒）越小越易达到吸收部分，药物吸收的越多
D. 吸入给药的吸收速度与药物的分子量大小成反比
E. 肺泡是吸入气雾剂与吸入喷雾剂中药物的主要吸收部分

正确答案：C。吸入的雾滴（粒）越小越易达到吸收部分，药物吸收的越多

解析：本题考查的是气雾剂吸收与作用特点。粒子过小，雾滴（粒）易到达肺泡部位，但沉积减少，多被呼出，吸收较少（C错，为本题正确答案）。气雾剂系指原料药物或原料药物和附加剂与适宜的抛射剂共同装封于具有特制阀门系统的耐压容器中，使用时借助抛射剂的压力将内容物呈雾状物喷出，用于肺部吸入或直接喷至腔道黏膜、皮肤的制剂。气雾剂内容物喷出后呈泡沫状或半固体状，则称之为泡沫剂或凝胶剂/乳膏剂。按用药途径，气雾剂可分为吸入气雾剂与非吸入气雾剂。喷雾剂系指原料药或与适宜辅料填充于特制的装置中，使用时借助手动泵的压力、高压气体、超声振动或其他方法将内容物呈雾状物释出，用于肺部吸入或直接喷至腔道黏膜及皮肤等的制剂。按用药途径，喷雾剂可分为吸入喷雾剂、鼻用喷雾剂及用于皮肤、黏膜的非吸入喷雾剂。吸入气雾剂和吸入喷雾剂给药时，药物以雾状吸入可直接作用于支气管平滑肌（A对），适宜粒径的雾滴在肺泡部位有较好的分布和沉积，肺泡为药物的主要吸收部位（E对）。影响吸入气雾剂和吸入喷雾剂药物吸收的主要因素有：①药物的脂溶性及分子大小，吸入给药的吸收速度与药物的脂溶性成正比（B对），与药物的分子大小成反比（D对）。②雾滴（粒）粒径大小，雾滴（粒）的大小影响其在呼吸道沉积的部位，吸入气雾剂雾滴（粒）的粒径应在10μm以下，其中大多数应在5μm以下。雾滴过粗，药物易沉着在口腔、咽部及呼吸器官的各部位；粒子过小，雾滴（粒）易到达肺泡部位，但沉积减少，多被呼出，吸收较少。